富含多酚类物质的食物是
A. 肉类、粮谷类
B. 豆类和茶叶
C. 蔬菜、粮谷类
D. 蔬菜、水果、豆类、茶叶
E. 植物油、肉类

正确答案：B。豆类和茶叶